培养真菌最适宜的pH是
A. 1～2
B. 3～4
C. 5～6
D. 7～8
E. 9～10

正确答案：C。5～6